引起医院感染的病原体中，最主要的是
A. 细菌
B. 病毒
C. 真菌
D. 衣原体
E. 支原体

正确答案：A。细菌

解析：引起医院感染的的病原体中，细菌约占90%以上，且以革兰阴性杆菌为主，此外，病毒、真菌、衣原体、支原体和原虫等亦有可能引起医院感染。掌握“医院感染及细菌的致病性”知识点。